龈下刮治放入器械时，工作端平面与牙根之间的最佳角度是
A. 0°
B. 40°
C. 80°
D. 90°
E. 110°

正确答案：A。0°

解析：本题考查龈下刮治。龈下刮治放入器械时，工作端平面与牙根之间的最佳角度是0°（A对）。龈下刮治时，刮治器工作端以0°角（A对）即与牙根平行放入牙周袋，到达袋底后，与根面逐渐成45°角，以探查根面牙石，探到牙石根方后，随即与牙面形成约80°角（C错）进行刮治。40°（B错）、90°（D错）、110°（E错）都不是规范的操作角度，无法很好的实施刮治术，也得不到好的刮治效果。